新生儿开始排便的时间常为生后
A. 24小时
B. 36小时
C. 48小时
D. 60小时
E. 72小时

正确答案：A。24小时

解析：新生儿开始排便的时间常为生后24小时内（A对），24小时仍不排胎便，应排除肛门闭锁或其他消化道畸形。